下列信息源中属于一级信息源的
A. 杂志
B. 药典
C. 摘要
D. 参考书
E. 数据库

正确答案：A。杂志

解析：本题考查药物信息的分类。一级信息源指原始文献和资料，如期刊、杂志（A对）；二级信息源则为对原始文献和资料进行的初步汇总和分类，如索引（B错）和摘要（C错）等；三级信息源包括对文献资料进行细致地归纳、综合、整理后的出版物，如参考书（D错）、数据库（E错）等。